防己的主治病证有
A. 水肿
B. 寒湿中阻
C. 脚气浮肿
D. 小便不利
E. 风湿痹痛

正确答案：A、C、D、E。水肿；脚气浮肿；小便不利；风湿痹痛

解析：本题考查的是防己的主治病证。防己的主治病证有水肿（A对）、脚气浮肿（C对）、小便不利（D对）与风湿痹痛（E对）。防己：【主治病证】（1）风湿痹痛，尤以热痹为佳。（2）水肿，腹水，脚气浮肿，小便不利。草豆蔻：【主治病证】（1）寒湿中阻（B错）之胀满疼痛。（2）寒湿中阻之呕吐、泄泻。